男，45岁，高空坠落5小时，伤后意识丧失5分钟，清醒后头痛恶心两次，烦躁，左侧外耳道流出混血性液体，CT检查提示，新月形，少量积气，目前治疗不合适的是
A. 填塞耳道
B. 暂不手术治疗
C. 避免用力咳嗽
D. 头高卧位休息
E. 预防性使用抗生素

正确答案：A。填塞耳道

解析：中年男性患者，有高空坠落外伤史，伤后意识丧失5分钟，清醒后头痛恶心两次，烦躁（颅高压表现），左侧外耳道流出混血性液体（考虑颅中窝骨折），CT检查提示颅内新月形，少量积气（颅骨骨折合并硬膜下血肿），根据患者的临床表现、体征和影像学检查结果，最可能的诊断是颅骨骨折（骨折部位为颅中窝），合并急性硬膜下血肿，根据患者目前的情况，暂不需要手术治疗（B对），严密观察24小时或更长时间，观察意识、瞳孔生命体征及神经系统体征的变化，对症处理相关症状，同时需要向家属说明迟发型颅内血肿及其他病情变化的可能，最适宜的处理方式为病人须取头高位并绝对卧床休息（D对），避免用力咳嗽、打喷嚏和擤鼻涕（C对），同时给予抗生素预防颅内感染治疗（E对），一般不堵塞或冲洗破口处，不做腰穿（A错，为本题正确答案）。